善于治疗吐泻转筋的药物是
A. 威灵仙
B. 木瓜
C. 昆明山海棠
D. 海风藤
E. 蕲蛇

正确答案：B。木瓜

解析：木瓜的功效为舒筋活络，和胃化湿。可用于治疗暑湿吐泻，转筋挛痛。木瓜温香入脾，能化湿和胃，湿去则中焦得运，泄泻可止；味酸入肝，可舒筋活络而缓挛急；治湿阻中焦之腹痛吐泻转筋，偏寒湿者，常配吴茱萸、小茴香、紫苏等；偏暑湿者，多配蚕沙、薏苡仁、黄连等如蚕矢汤（B对）。威灵仙功效祛风湿，通经络，止痛，消骨骾，可用于治疗风湿痹痛，骨骾咽喉（A错）。昆明山海棠功效祛风除湿，活血止痛，续筋接骨，可用于治疗风湿痹证，跌打损伤，骨折（C错）。海风藤功效祛风湿，通经络，止痹痛，可用于治疗风寒湿痹，肢节疼痛，筋脉拘急，屈伸不利，跌打损伤（D错）。蕲蛇功效祛风，通络，止痉，可用于治疗风湿顽痹，麻木拘挛，中风，小儿惊风，破伤风，麻风，疥癣（E错）。